龈谷易成为牙周病的始发部位是因为
A. 该处上皮细胞间联系疏松
B. 该处上皮无角化、为非自洁区
C. 该处上皮不全角化，上皮厚度薄
D. 该处上皮下无结缔组织的固有层
E. 该处容易嵌塞食物，导致细菌滞留和繁殖

正确答案：B。该处上皮无角化、为非自洁区

解析：本题考查龈谷易成为牙周病的始发部位的原因。龈谷处上皮无角化，为非自洁区，对局部刺激物的抵抗力较低，因此牙周病易始发于此（B对）。龈谷处为非自洁区，该处由于不易清洁导致细菌滞留和繁殖（E错）。龈谷由附着龈构成，上皮细胞间联系紧密（A错）。龈谷属于牙龈的一部分，牙龈由上皮层和固有层构成，固有层中含有致密的结缔组织（D错）。